选择可摘局部义齿基牙的原则中，错误的是
A. 选择健康牙作基牙
B. 虽有牙体疾病，但已经治疗
C. 虽有牙周疾病，但已得到控制
D. 越近缺隙的牙作基牙固位，支持效果越好
E. 选用多个基牙时，彼此越平行越好

正确答案：E。选用多个基牙时，彼此越平行越好

解析：本题考查选择可摘局部义齿基牙的原则。选择可摘局部义齿基牙的原则中，错误的是选用多个基牙时，彼此越平行越好（E错，为本题的正确答案）。可摘局部义齿应选择健康牙作基牙（A对），要求牙冠长短合适、有一定倒凹、牙体牙周组织健康、支持力强的牙作基牙，保证义齿较好的固位。患牙虽有牙体牙髓病但经过完善的治疗后可以选用（B对）。患牙有轻度牙周病但经治疗炎症得到控制的牙可以选用（C对）。对于基牙选择应首选近缺隙两端的牙（D对），且基牙之间越分散越好，使在基牙上的义齿固位体呈面支撑状态，有利于义齿行使功能时更加稳定。